大多数患牙都对温度刺激表现敏感的牙髓炎是
A. 多根牙慢性闭锁性牙髓炎
B. 多根牙慢性溃疡性牙髓炎
C. 多根牙残髓炎
D. 多根牙逆行性牙髓炎
E. 多根牙慢性增生性牙髓炎

正确答案：B。多根牙慢性溃疡性牙髓炎

解析：本题考查慢性牙髓炎。大多数患牙都对温度刺激表现敏感的牙髓炎是慢性溃疡性牙髓炎（B对）。慢性溃疡性牙髓炎典型症状是当冷、热刺激激惹患牙时，会产生剧烈疼痛。慢性闭锁性牙髓炎（A错）有长期的冷热刺激痛史，对温度刺激反应可为敏感，也可为迟热测引起迟缓性痛。逆行性牙髓炎（D错）呈慢性牙髓炎的表现，冷热刺激为激发痛，迟钝或无反应。残髓炎（C错）对患牙施以强冷热或强热刺激进行温度测验，其反应可为迟缓性疼痛或仅诉有感觉。慢性增生性牙髓炎（E错）典型特点是牙髓息肉，进食疼痛出血。